乳香的化学成分分类属于
A. 单树脂
B. 胶树脂
C. 油胶树脂
D. 油树脂
E. 香树脂

正确答案：C。油胶树脂

解析：本题考查的是树脂的分类和组成。乳香的化学成分分类属于油胶树脂（C对）。树脂主要由树脂酸、树脂醇、树脂酯、树脂烃等多种成分组成。在树脂中常混有挥发油、树胶及游离芳香酸等成分。药用树脂的分类通常根据其中所含的主要化学成分而分成以下几类。（1）单树脂（A错）类：树脂中一般不含或很少含挥发油、树胶及游离芳香酸，通常又分为：①酸树脂：主成分为树脂酸，如松香。②酯树脂：主成分为树脂酯，如枫香脂、血竭。③混合树脂：无明显的主成分，如洋乳香。（2）胶树脂（B错）类：主成分为树脂和树胶，如藤黄。（3）油胶树脂类：主成分为树脂、挥发油和树胶，如乳香、没药、阿魏。（4）油树脂（D错）类：主成分为树脂与挥发油，如松油脂、加拿大油树脂。（5）香树脂（E错）类：主成分为树脂、游离芳香酸（香脂酸）、挥发油，如苏合香、安息香等。